患者，男，65岁，患2型糖尿病12年，3日前来诊，血压156/98mmHg，体重指数20，颜面及双下肢轻度可凹性水肿，检查尿蛋白（++）。血清肌酐130㎛ol/L。对其宜选用的药品是
A. 二甲双胍+氨氯地平
B. 二甲双胍+福辛普利
C. 格列喹酮+氨氯地平
D. 格列喹酮+福辛普利
E. 格列美脲+氢氯噻嗪

正确答案：D。格列喹酮+福辛普利

解析：本题考查高血压的治疗。对其宜选用的药品是格列喹酮+福辛普利（D对）。该患者本身患有2型糖尿病，血压值显示该患者患有高血压，尿蛋白阳性显示该患者患有肾病。血管紧张素转换酶抑制剂（ACEI）或血管紧张素Ⅱ受体拮抗剂（ARB）能有效减轻和延缓糖尿病肾病的进展。糖尿病合并肾病者可首选格列喹酮。故用药宜选用的药品为ACEI/ARB+格列喹酮，福辛普利为ACEI类药物。氨氯地平（AC错）、氢氯噻嗪（E错）、二甲双胍（B错）不适用糖尿病合并肾病者。